菌斑控制的用具，除外
A. 牙间隙刷
B. 牙刷
C. 牙膏
D. 牙线
E. 口服抗生素

正确答案：E。口服抗生素

解析：菌斑控制的方法较多，有机械的方法和化学的方法。但目前仍以机械清除菌斑的效果最为确切。如刷牙、牙线、牙签、牙间隙刷。掌握“慢性龈炎”知识点。